位于颅中窝的结构是
A. 眶下裂
B. 棘孔
C. 筛孔
D. 颈静脉孔
E. 舌下神经管内口

正确答案：B。棘孔

解析：蝶鞍两侧，由前内向后外，依次可见圆孔、卵圆孔和棘孔（B对）。筛孔属于颅前窝的结构（C错），眶下裂不属于颅中窝的结构（A错），颈静脉孔（D错）和舌下神经管内口（E错）属于颅后窝的结构。